《中国药典》规定，以大黄酚作为指标成分之一进行含量测定的药材是
A. 紫草
B. 丹参
C. 厚朴
D. 细辛
E. 决明子

正确答案：E。决明子

解析：本题考查决明子的主要蒽醌类成分。《中国药典》以大黄酚、橙黄决明素为指标成分对决明子（E对）进行含量测定，含量分别不得少于0.20%和0.80%。《中国药典》采用紫外分光光度法测定紫草（A错）药材中羟基萘醌总含量，以左旋紫草素计，不得少于0.80%。《中国药典》采用高效液相色谱法测定丹参（B错）中丹参酮类和丹酚酸B的含量，要求丹参酮ⅡA、隐丹参酮和丹参酮Ⅰ的总量不得少于0.25%，丹酚酸B不得少于3.0%。厚朴（C错）中主要化学成分为木脂素类化合物，包括厚朴酚以及和厚朴酚等，《中国药典》采用高效液相色谱法测定厚朴药材中厚朴酚与和厚朴酚的含量，两者总含量不得少于2.0%。《中国药典》以细辛脂素为指标成分对细辛（D错）进行含量测定，要求其含量不得少于0.050%。